下列各项，不属于弦脉所主的病症是
A. 肝郁
B. 胃热
C. 诸痛
D. 痰饮
E. 疟疾

正确答案：B。胃热

解析：足阳明经属络于胃，胃热则阳明热盛。洪脉多见于阳明气分热盛（B错，为本题正确答案）。弦脉的脉象特点是脉形端直而形长如按琴弦，脉势较强、脉道较硬，切脉时有挺然指下、直起直落的感觉。多见于肝胆病（A对）、疼痛（C对）、痰饮（D对）等，或胃气衰败。若疟邪（E对）侵入人体，伏于半表半里之间，少阳枢机不利亦可见弦脉，如《金匾要略》谓“疟脉自弦”。